患者，女，25岁，已婚。近半年来常感小腹部隐痛，拒按，痛连腰骶，劳累时加重，带下量多，色黄，质粘稠，胸闷纳呆，口干便秘，小便黄赤，舌体胖大，色红，苔黄腻，脉滑数。治疗应首选
A. 膈下逐瘀汤
B. 少腹逐瘀汤
C. 银甲丸
D. 理冲汤
E. 止带方

正确答案：C。银甲丸

解析：题中患者近半年来常感小腹部隐痛，拒按，痛连腰骶，故诊断为盆腔炎。湿热余邪与气血搏结于冲任胞宫，故小腹部隐痛，拒按；劳累耗伤气血，正气虚衰，故劳累时加重；湿热下注，故带下量多，色黄，质粘稠；湿热瘀结内伤，故胸闷纳呆，口干便秘，小便黄赤；舌体胖大，色红，苔黄腻，脉滑数均为湿热瘀结之象，故辨为湿热瘀结证，治宜清热利湿，化瘀止血。膈下逐瘀汤为慢性盆腔炎气滞血瘀证的选方，功能活血化瘀，理气止痛（A错）。少腹逐瘀汤功能活血祛瘀，温经止痛，主治寒凝血瘀证（B错）。慢性盆腔炎湿热瘀结证治宜清热利湿，化瘀止血，方选银甲丸（C对）。理冲汤功能益气健脾，化瘀散结，为治疗慢性盆腔炎气虚血瘀证的选方（D错）。止带方功能清利湿热，解毒杀虫，为治疗带下过多湿热下注证的选方（E错）。